有阈值效应
A. 能够检测出阈值的效应属有阈值效应
B. 一般的生理、生化异常和器官、组织的病理改变都属于有阈值效应
C. 发育毒性或胚胎毒性引起的结果属于有阈值效应
D. 生殖细胞突变引起的生殖毒性也属无阈值效应
E. 以上都不是

正确答案：A。能够检测出阈值的效应属有阈值效应